石斛夜光丸除了可以清肝明目外，还可以
A. 滋肾养肝
B. 补脾益肾
C. 健脾益气
D. 补血养肝
E. 滋阴补肾

正确答案：E。滋阴补肾

解析：本题考查石斛夜光丸的功能。石斛夜光丸除了可以清肝明目外，还可以滋阴补肾（E对）。石斛夜光颗粒（丸）【功能】滋阴补肾，清肝明目。杞菊地黄丸（片、浓缩丸、口服液、胶囊）【功能】滋肾养肝（A错）。止泻灵颗粒【功能】健脾益气（C错），渗湿止泻。